热原不具备的性质是
A. 水溶性
B. 耐热性
C. 挥发性
D. 可被活性炭吸附
E. 可滤过性

正确答案：C。挥发性

解析：本题考查热原的性质。热原的性质：（1）水溶性（A对）；（2）不挥发性（C错，为本题正确答案）；（3）耐热性（B对）；（4）过滤性（E对）：热原体积较小，在1～5nm间，一般滤器均可通过，不能被截留去除，但活性炭可吸附热原（D对），纸浆滤饼对热原也有一定的吸附作用。（5）其他性质。热原能被强酸、强碱、强氧化剂如高锰酸钾、过氧化氢以及超声波破坏。热原在水溶液中带有电荷，也可被某些离子交换树脂所吸附。